母乳性黄疸的特点，下列哪项是错误的
A. 多于生后3～8天出现黄疸
B. 1～3周达高峰
C. 胆红素在停止哺乳24～72小时后即下降
D. 食欲差，体重不增
E. 继续哺乳1～3个月胆红素亦降至正常

正确答案：D。食欲差，体重不增

解析：母乳性黄疸患儿黄疸现于出生1周后，2周左右（B对）达高峰然后逐渐下降。若继续母乳喂养黄疸可延续1-3个月（E对）方消退...母乳性黄疸一般不需任何治疗，停喂母乳24-48小时（C对）黄疸可明显减轻。几乎2/3母乳喂养的新生儿可出现这种黄疸，新生儿的食欲及体重不会受到严重影响（D错）。按八年制教材母乳性黄疸多现于1周后，严格意义上此题A和D都错误，原答案是D。